患儿，女，12岁。3周前患急性扁桃体炎。突然出现窦性心动过速。心搏微弱。心尖区有收缩期吹风样杂音，实验室检查有链球菌感染，确诊为急性风湿热，除用青霉素控制链球菌感染外，应选哪种药治疗
A. 阿司匹林
B. 布洛芬
C. 对乙酰氨基酚
D. 保泰松
E. 吲哚美辛

正确答案：A。阿司匹林